治疗脑水肿的首选药是
A. 甘露醇
B. 螺内酯
C. 呋塞米
D. 氧噻嗪
E. 氢氯噻嗪

正确答案：A。甘露醇

解析：甘露醇是治疗脑水肿、降低颅内压安全而有效的首选药物。也可用于青光眼急性发作和患者术前应用以降低眼内压。掌握“保钾利尿药和渗透性利尿药”知识点。